能明显引起呼吸加深加快的缺氧类型是
A. 低张性缺氧
B. 血液性缺氧
C. 循环性缺氧
D. 组织性缺氧
E. 高铁血红蛋白血症所致的缺氧

正确答案：A。低张性缺氧

解析：低张性缺氧（A对）时Pa02降低，可兴奋呼吸中枢，使呼吸加深加快。而血液性缺氧（B错）、循环性缺氧（C错）及组织性缺氧（D错）的Pa02正常，故不会引起明显的呼吸加深加快。高铁血红蛋白血症所致的缺氧（E错）属于血液性缺氧。